交感神经节前纤维何者错误？
A. 起自脊髓中间带内侧核
B. 部分纤维终止于椎旁节
C. 部分纤维在交感干内上升或下降，然后终止于上、下方的椎旁节
D. 经脊神经前支白交通支进入交感干
E. 部分纤维穿椎旁节终止于椎前节

正确答案：A。起自脊髓中间带内侧核

解析：交感神经节前纤维由脊髓中间外侧核发出（A错，为本题正确选项），经脊神经前根、脊神经、白交通支进入交感干内（D对），有3种去向：①终止于相应的椎旁神经节（B对），并交换神经元。②在交感干内上行或下降后，终于上方或下方的椎旁神经节（C对）。③穿过椎旁节后，至椎前节交换神经元（E对）。